治疗热淋，应首选
A. 二妙散
B. 八正散
C. 疏凿饮子
D. 程氏萆薢分清饮
E. 薏苡仁汤

正确答案：B。八正散

解析：热淋的病机为湿热蕴结下焦，膀胱气化失司，治疗应清热利湿通淋，代表方为八正散（B对）。二妙散，其功用为清热燥湿，适用于湿热下注证（A错）。疏凿饮子，其功用为泻下逐水，疏风发表的作用，可用于治疗水肿之湿热壅盛证（C错）。程氏萆薢分清饮，其功用为清热利湿，分清泄浊，可用于尿浊之湿热下注证（D错）。薏苡仁汤，其功用为健脾祛湿，发散风寒的作用，可用于治疗着痹证（E错）。